在采收加工时需要“发汗”的药材有
A. 厚朴
B. 杜仲
C. 续断
D. 青蒿
E. 茯苓

正确答案：A、B、C、E。厚朴；杜仲；续断；茯苓

解析：本题考查的是中药材的采收加工。在采收加工时需要“发汗”的药材有厚朴（A对）、杜仲（B对）、续断（C对）与茯苓（E对）。发汗：有些药材在加工过程中为了促使变色，增强气味或减小刺激性，有利于干燥，常将药材堆积放置，使其发热、“回潮”，内部水分向外挥散，这种方法称为“发汗”，如厚朴、杜仲、玄参、续断、茯苓等。青蒿（D错）：【采收加工】秋季花盛开时采割，除去老茎，阴干。